《中国药典》2010年版一部规定，检查甘草中重金属及有害元素用
A. 高效液相色谱-质谱法
B. 紫外-可见分光光度法
C. 原子吸收分光光度法
D. 高效液相色谱法
E. 气相色谱法

正确答案：C。原子吸收分光光度法

解析：本题考查的是中药有毒有害物质的检测方法。《中国药典》2010年版一部规定，检查甘草中重金属及有害元素用原子吸收分光光度法（C对）。铅、镉、砷、汞、铜测定：《中国药典》采用原子吸收分光光度法（第一法）和电感耦合等离子体质谱法（第二法）测定中药中铅、镉、砷、汞、铜的含量，并规定甘草、黄芪、丹参、白芍、西洋参、金银花、枸杞子、山楂、阿胶、牡蛎、珍珠、蛤壳等含铅不得过5mg/kg，镉不得过0.3mg/kg，砷不得过2mg/kg，汞不得过0.2mg/kg，铜不得过20mg/kg。海螵蛸含铅不得过5mg/kg，镉不得过5mg/kg，砷不得过10mg/kg，汞不得过0.2mg/kg，铜不得过20mg/kg。使用高效液相色谱-质谱（A错）技术对国产千里光、川楝子、苦楝皮中的毒性成分进行限量检査。紫外-可见分光光度法（B错）具有灵敏、简便、准确，既可作定性分析又可作含量测定等优点，适用于大类成分的含量测定，如总黄酮、总生物碱、总蒽醌等。高效液相色谱法（D错）可用来测定一些毒性的毒性成分。目前对中药中肝毒性成分吡咯里西啶生物碱、肾毒性成分马兜铃酸等常用的检测方法是高效液相色谱法、高效毛细管电泳及其与质谱联用等技术。《中国药典》对毒性成分生物碱等采用高效液相色谱法，如制川乌、制草乌、附子中的双酯型生物碱（以含新乌头碱、次乌头碱、乌头碱的总量计）进行限量检查；马钱子中的士的宁，斑蝥中的斑蝥素等设定了含量范围。气相色谱法（E错）可测定药材及制剂中部分有机氯、有机磷和拟除虫菊酯类的农药残留量。